左旋咪唑的临床应用有
A. 器官移植后的抗排斥
B. 肿瘤放化疗的辅助治疗
C. 肺结核
D. 蛔虫病
E. 红斑狼疮

正确答案：B、D、E。肿瘤放化疗的辅助治疗；蛔虫病；红斑狼疮

解析：本题考查左旋咪唑的临床应用。左旋咪唑是一种抗寄生虫感染的药物，可用于蛔虫病（D对）。同时还具有调节机体免疫功能，提高机体免疫力的作用，用于肿瘤放化疗的辅助治疗（B对）以及红斑狼疮（E对）。